精神分裂症的临床症状一般没有
A. 意识障碍
B. 情感障碍
C. 感知障碍
D. 思维障碍
E. 行为障碍

正确答案：A。意识障碍

解析：目前，将精神分裂症定义为，一组病因未明的精神病，多起病于青壮年，常有感知（C对）、思维（D对）、情感（B对）、行为（E对）等多方面的障碍和精神活动不协调。一般无意识障碍（A错，为本题正确答案）和明显的智能障碍，病程多迁延。